男，45岁。右足底外伤5小时，伤口深，及时彻底清创后，TAT（破伤风抗毒素）皮试阳性。首先考虑给予注射
A. 人体破伤风免疫球蛋白
B. 破伤风抗毒素（脱敏注射）
C. 青霉素
D. 破伤风类毒素
E. 百喉、百日咳、破伤风三联疫苗

正确答案：B。破伤风抗毒素（脱敏注射）

解析：患者中年男性，右足底外伤，伤口深（创伤时破伤风可污染深部组织），考虑有破伤风的可能，破伤风的预防主要包括早期清创和人工免疫。人工免疫包括被动免疫和主动免疫，被动免疫目前主要选择皮下注射TAT（破伤风抗毒素），TAT易发生过敏反应，使用前进行皮内敏感实验，如过敏，应按脱敏法注射（B对）；主动免疫适用于5-7年内基础注射破伤风类毒素的患者（D错）；人体破伤风免疫球蛋白（A错）是目前最佳的被动免疫方法，但由于价格相对昂贵，一般不作为首选治疗方法；小儿计划免疫中通常实施百喉、百日咳、破伤风三联疫苗（E错）。青霉素（C错）用于早期杀灭破伤风梭菌，减少破伤风痉挛毒素的释放，但不能中和人体中已释放的破伤风痉挛毒素。